木火刑金属于
A. 母病及子
B. 相乘传变
C. 子病犯母
D. 相侮传变
E. 制化传变

正确答案：D。相侮传变

解析：木火刑金为木对金的异常制约，金为木之所不胜，故木火刑金是相侮传变（D对）。母病及子（A错），指五行中的某一行异常，累及其子行，导致母子两行皆病。相乘传变（B错）是五行中某一行过于亢盛，对其所胜进行超过正常限度的克制，引起其所胜行的虚弱，导致五行之间的协调关系失常。子病及母（C错），指五行中某一行异常，影响到其母行，终导致子母两行皆异常。因此木病当及火。五行制化（E错），指五行之间既相互资生，又相互制约，维持平衡协调，推动事物间稳定有序的变化与发展。